溶解氧的含量可作为
A. 有机物污染的间接指标
B. 水体污染的间接指标
C. 水体污染及自净快慢的间接指标
D. 水体无机物污染的直接指标
E. 水体有机物污染的直接指标

正确答案：A。有机物污染的间接指标

解析：本题考查溶解氧含量。溶解氧指溶解在水中的氧含量。当有机物污染水体或藻类大量死亡时，水中溶解氧可被消耗，若消耗氧的速度大于空气中的氧通过水面溶入水体的复氧速度，则水中溶解氧持续降低，进而使水体处于厌氧状态，此时水中厌氧微生物繁殖，有机物发生腐败分解，生成NH₃、H₂S等，使水发臭发黑。因此溶解氧含量可作为评价水体受有机性污染及其自净程度的间接指标（A对BCDE错）。